颞下颌关节的功能面是
A. 关节结节前斜面和髁状突前斜面
B. 关节结节后斜面和髁状突后斜面
C. 关节结节后斜面和髁状突前斜面
D. 关节结节前后斜面和髁状突横嵴
E. 以上均不正确

正确答案：C。关节结节后斜面和髁状突前斜面

解析：本题考查颞下颌关节的解剖特点。颞下颌关节的功能区是髁突的前斜面和关节结节的后斜面（C对），而不是髁突顶部和关节窝顶部。